支配心脏的交感神经所释放的递质是
A. 肾上腺素
B. 去甲肾上腺素
C. 多巴胺
D. γ-氨基丁酸（GABA）
E. 乙酰胆碱

正确答案：B。去甲肾上腺素